相关系数r的正、负取决于下列哪一项的正、负
A. lxx
B. lyy
C. ∑x
D. ∑y
E. lxy

正确答案：E。lxy